由病毒携带、将宿主DNA片段从一个细胞转移至另一细胞的现象或机制，称为
A. 转座作用
B. 重组作用
C. 转化作用
D. 接合作用
E. 转导作用

正确答案：E。转导作用

解析：由病毒携带、将宿主DNA片段从一个细胞转移至另一个细胞的现象或机制，称为转导作用。掌握“DNA重组与基因工程”知识点。